下列药物中服用后可在乳汁中分泌较多的是
A. 青霉素G
B. 头孢呋辛
C. 华法林
D. 地西泮
E. 氨苄西林

正确答案：D。地西泮

解析：本题考查乳汁分泌。下列药物中服用后可在乳汁中分泌较多的是地西泮（D对）。脂溶性高（如地西泮）、弱碱性药物（如红霉素）、分子量小、与血浆蛋白结合率低的药物容易分泌到乳汁中。磺胺类药物、青霉素类（AE错）、头孢菌素类（B错）药物属于酸性药物，不易分泌到乳汁中。华法林（C错）的血浆蛋白结合率高，不宜分泌到乳汁中。